执业药师在咨询服务和用药指导过程中，需特别提示的情形有
A. 首次使用的药品
B. 多种药物合并应用
C. 使用含有毒成分的药品
D. 处方用法与说明书不一致
E. 使用需特殊条件贮存的药品

正确答案：A、B、C、D、E。首次使用的药品；多种药物合并应用；使用含有毒成分的药品；处方用法与说明书不一致；使用需特殊条件贮存的药品

解析：本题考查的是执业药师需特别提示的特殊情况。执业药师在咨询服务和用药指导过程中，需特别提示的情形有首次使用的药品（A对）、多种药物合并应用（B对）、使用含有毒成分的药品（C对）、处方用法与说明书不一致（D对）与使用需特殊条件贮存的药品（E对）。执业药师需特别提示的特殊情况：（1）患者同时使用2种或2种以上含同一成分的药品时；或合并用药较多时。（2）当患者用药后出现不良反应时；或既往曾发生过不良反应事件。（3）当患者依从性不好时；或患者认为疗效不理想，或剂量不足以有效时。（4）病情需要，处方中配药剂量超过规定剂量时（需医师双签字）。处方中用法用量与说明书不一致，或非药品说明书中所指示的用法、用量、适应证时。（5）超越说明书范围的适应证或超过说明书范围的使用剂量（需医师双签字确认）。（6）患者正在使用的药物中有配伍禁忌或配伍不当时（如有明显配伍禁忌时应第一时间联系该医师以避免纠纷的发生）。（7）第一次使用该药的患者。（8）近期药品说明书有修改（如商品名、适应证、剂量、有效期、贮存条件、药品不良反应）。（9）患者所用的药品近期发现严重或罕见的不良反应。（10）使用含有毒中药或有毒成分药品的患者。（11）同一种药品有多种适应证或用药剂量范围较大或剂量接近阈值时。（12）药品被重新分装，而包装的标识物不清晰时。（13）使用需特殊贮存条件的药品时；或使用临近有效期药品时。